女，80岁，摔伤致右肱骨外科颈粉碎骨折，伴有高血压肺心病。其最佳治疗方法是
A. 三角巾悬吊
B. 肩关节融合手术
C. 切开复位钢板内固定术
D. 切开复位髓内针固定术
E. 手法复位外固定术

正确答案：A。三角巾悬吊

解析：患者右肱骨外科颈粉碎性骨折，属Neer二型（P633 Neer分型），加之患者高龄、伴有高血压肺心病，一般情况较差，故其最佳治疗方法是三角巾悬吊（A对），任其自然愈合，不必进行复位及制动，以免造成关节僵硬。肩关节融合术（B错）主要用于严重的损伤性关节炎、关节结核和先天畸形等。该患者全身基本情况较差，手术治疗风险较大，不适合手术疗法如切开复位内固定术（CD错）。患者为右肱骨外科颈粉碎性骨折，手法复位外固定术不适用（E错）。